高血压
A. 受感染的人作为传染源
B. 受感染的动物作为传染源
C. 两者都是
D. 两者都不是

正确答案：D。两者都不是

解析：本题考查高血压的传染源。高血压不是传染病，以上两者均不是（D对ABC错）高血压的致病因素。